通常高度每升高100m，气温下降
A. 0.55℃
B. 0.65℃
C. 0.75℃
D. 0.85℃
E. 1.00℃

正确答案：B。0.65℃

解析：本题考查大气温度垂直递减率。在标准大气条件下，对流层内气温随高度的增加而逐渐降低。大气温度的这种垂直变化常用大气温度垂直递减率来表示，其定义为：高度每增加100m气温下降的度数，通常为0.65℃（B对ACDE错）。